青春期的生理特点，哪项除外
A. 第二性征发育
B. 内、外生殖器官从幼年型变为成年型
C. 月经周期常不规则
D. 生殖系统功能已完善
E. 月经初潮是青春期的标志

正确答案：D。生殖系统功能已完善

解析：本题考查女性生殖系统生理。青春期此期生理特点有：第一性征发育即生殖器官发育。生殖器官从幼稚型变为成人型（B对）。生殖系统功能尚未完善（D错，为本题正确答案）。第二性征出现（A对）包括音调变高，乳房发育，出现阴毛及腋毛，骨盆横径发育大于前后径，胸、肩、髋部皮下脂肪增多，形成女性特有体态。乳房发育是女性第二性征的最初特征，为女性青春期发动的标志。接近10岁时乳房开始逐渐发育，数月至1年后开始生长阴毛及腋毛。月经初潮为青春期的重要标志（E对）。通常发生于乳房发育2.5年。此时月经周期常不规则（C对）。